早产儿，胎龄32周，生后3小时出现呼吸困难，呻吟，胸部X线片时双肺透亮度降低，毛玻璃样改变。应立即给予的处理是
A. 地塞米松
B. 持续气道正压通气
C. 面罩吸氧
D. 纠正酸中毒
E. 抗生素

正确答案：B。持续气道正压通气

解析：患儿32周（早产儿，缺乏肺表面活性物质，胎肺不成熟），生后3小时出现呼吸困难，呻吟；腹部X线片时双肺透亮度降低，毛玻璃样改变（RDS典型X线表现），据患儿病史、临床表现和X线诊断为新生儿呼吸窘迫综合征（RDS）。早产儿肺表面活性物质（PS）缺乏是造成疾病的主要原因，PS缺乏导致肺泡表面张力增大，肺泡萎陷，造成肺水肿及肺不张。持续性正压通气（CPAP）有助于防止肺泡萎陷，帮助自主呼吸（B对）。地塞米松（A错）等激素治疗是用于所有产前不足34周的高危孕妇。面罩吸氧（C错）用于轻症患者，与本患儿疾病严重程度不符。纠正酸中毒（D错），抗生素（E错）可作为RDS后续治疗。